患者意识障碍，可唤醒，但不能准确辨别人物和地点。这种意识状态称为
A. 谵妄
B. 浅昏迷
C. 昏睡
D. 意识模糊
E. 嗜睡

正确答案：D。意识模糊

解析：意识模糊是一种意识内容改变为主的意识障碍，意识清晰度下降，较嗜睡为深，能保持简单的精神活动，但对时间、地点、人物的定向能力发生障碍，本例患者意识障碍，可唤醒，但不能准确辨别人物和地点（时间、地点、人物的定向障碍），故诊断为意识模糊（D对）。谵妄指患者在意识清晰度降低的同时出现大量的幻觉、错觉，这些幻觉和错觉以形象鲜明的恐怖性幻视和错视为主，如猛兽、毒蛇等（A错）。昏睡意识清晰度较意识模糊更低，表现为患者的周围环境定向力和自我定向力均丧失（C错），没有言语能力。嗜睡是指意识清晰度降低较轻微，表现为患者在安静环境中经常昏昏入睡，但给予刺激后可以立即醒转，并能进行简单应答，但停止刺激后患者又进入睡眠状态（E错）。